十二指肠溃疡属于
A. 内科心身疾病
B. 儿科心身疾病
C. 外科心身疾病
D. 口腔科心身疾病
E. 皮肤科心身疾病

正确答案：A。内科心身疾病

解析：内科心身疾病：原发性高血压、原发性低血压、冠状动脉硬化性心脏病、阵发性心动过速、胃溃疡、十二指肠溃疡、神经性呕吐、神经性厌食症、溃疡性结肠炎、过敏性结肠炎；支气管哮喘、过度换气综合征、偏头痛、肌紧张性头痛、自主神经失调症、甲状腺功能亢进、艾迪生病、副甲状腺功能亢进、副甲状腺功能低下、垂体功能低下、糖尿病。掌握“心身疾病”知识点。